患儿，男，4岁，因发音不清家长带患儿前来就诊，口腔检查见，患儿舌不能自由前伸，勉强前伸时舌尖成W形，智力发育正常。该患儿还可出现哪些临床症状
A. 舌尖上抬困难
B. 可出现卷舌音障碍
C. 可舌腭音发音障碍
D. 在婴幼儿期可发生褥疮性溃疡
E. 以上均正确

正确答案：E。以上均正确

解析：本题考查舌系带过短的临床表现。患儿发音不清，舌前伸困难，勉强前伸时舌尖成W形，智力发育正常，综合考虑，引起患儿发音不清最可能的原因是舌系带过短。舌系带过短的表现主要有：舌不能自由前伸运动，勉强前伸时舌尖成W形同时舌尖上抬困难（A对）；出现卷舌音（B对）和舌腭音发音障碍（C对）。在婴幼儿期可因舌前伸时系带与下颌切牙切缘经常摩擦，发生褥疮性溃疡（D对）。以上均是（E对，为本题正确答案）该患儿可出现的临床症状。